治疗急性肝衰竭时，应限制使用的药物是
A. 支链氨基酸
B. 葡萄糖注射液
C. 谷氨酸钠
D. 脂肪乳剂
E. 乳果糖

正确答案：D。脂肪乳剂

解析：按照八版外科学的观点，支链氨基酸、葡萄糖注射液、谷氨酸钠、脂肪乳剂、乳果糖均为急性肝衰竭的一般治疗时的药物，本题无正确答案。事实上此处并不严谨，因脂肪乳剂在肝脏代谢，会加重肝脏负担，严重肝病、急性肝衰竭时不宜应用，故治疗急性肝衰竭时，应限制使用的药物是脂肪乳剂（D对）。葡萄糖（B错）和支链氨基酸（A错）可作为肠外营养剂为患者提供营养支持；谷氨酸钠（C错）可降低血氨；乳果糖（E错）是一种合成的双糖，在小肠内不被分解，到达结肠后可被乳酸杆菌、粪肠球菌等细菌分解为乳酸、乙酸而降低肠道的pH值，进一步使得肠道细菌产氨减少，并促进血液中的氨渗入肠道排出体外。